关于心身疾病，下列的提法中错误的是
A. 属于心理生理障碍
B. 心理治疗以森田疗法最为合适
C. 主要累及受自主神经支配的系统或器官
D. 由情绪因素引起，以躯体症状为主要表现
E. 症状的波动与心理因素特别是情绪因素密切相关

正确答案：B。心理治疗以森田疗法最为合适

解析：心身疾病是精神刺激引起的器质性病变，是心理生理障碍（A对）：由情绪因素引起，以躯体症状为主要表现（D对）。心身疾病的特点是：以躯体症状为主，有明确的病理生理过程：某种个性特征是疾病发生的易患素质：疾病的发生和发展与心理社会应激（如生活事件等）和情绪反应有关，症状的波动与心理因素特别是情绪因素密切相关（E对）：生物或躯体因素是某些心身疾病的发病基础，心理社会因素往往起“扳机”作用：心身疾病通常发生在自主神经支配的系统或器官（C对）：心身综合治疗比单用生物学治疗效果好。心身疾病的治疗方法有躯体症状治疗和心理治疗，根据患者的情况，治疗方案各有侧重：森田疗法的适应证是强迫症、疑病性神经症、焦虑性神经症和自主神经功能紊乱（B错，为本题正确选项）。